只接受对侧皮质核束的脑神经核为
A. 动眼神经核、滑车神经核
B. 面神经核、舌下神经核
C. 面神经核上部、舌下神经核
D. 面神经核下部、舌下神经核
E. 面神经核上部、疑核

正确答案：D。面神经核下部、舌下神经核

解析：因为面神经核下部和舌下神经核只接受单侧（对侧）皮质核束支配，所以只接受对侧皮质核束的脑神经核为面神经核下部、舌下神经核（D对）。